关于呋塞米的不良反应，错误的是
A. 耳毒性
B. 低钾血症
C. 低钠血症
D. 血尿酸浓度降低
E. 低氯性碱中毒

正确答案：D。血尿酸浓度降低

解析：呋塞米的不良反应：①水和电解质紊乱：表现为低血容量、低血钠（C对）、低血钾（B对）、低血镁及低氯性碱中毒（E对）。②耳毒性（A对）③高尿酸血症（D错）④胃肠道反应⑤其他（D错，为本题正确答案）。